为相反配伍的药物是
A. 大戟与乌头
B. 芫花与海藻
C. 乌头与半夏
D. 贝母与瓜蒌
E. 丹参与芍药

正确答案：C。乌头与半夏

解析：本题考查的是川乌的使用注意。为相反配伍的药物是乌头与半夏（C对）。川乌：【使用注意】本品性热有毒，故孕妇忌服，不宜过量或久服。反半夏、全瓜蒌、瓜蒌子、瓜蒌皮、天花粉、川贝母、浙贝母、白蔹、白及，畏犀角，均不宜同用（AD错）。酒浸毒性强，故不宜浸酒饮用。甘草反芫花、海藻（B错）。甘草：【使用注意】本品味甘，易助湿壅气，故湿盛中满者不宜服。反大戟、甘遂、芫花、海藻，均忌同用。大剂量服用甘草，易引起浮肿，故不宜大量久服。藜芦反丹参、赤芍（E错）。藜芦：【使用注意】本品有毒，内服宜慎。孕妇及体弱者忌服。不宜与细辛、赤芍、白芍、人参、丹参、玄参、沙参、苦参同用。